根尖孔的形成与下列哪项有关
A. 上皮根鞘
B. 成釉器
C. 牙囊
D. 牙乳头
E. 上皮隔

正确答案：E。上皮隔

解析：在牙根的形成过程当中，上皮根鞘向根尖处生长并呈45°角弯曲形成上皮隔，上皮隔中间的孔即为未来的根尖孔。掌握“牙体、牙周组织的形成”知识点。